床位在100张以上的医疗机构，其《医疗机构许可证》多长时间校验一次
A. 1年
B. 2年
C. 3年
D. 4年
E. 5年

正确答案：C。3年